风邪的致病特点是
A. 疼痛剧烈
B. 肌肤不仁
C. 周身困重
D. 迫血妄行
E. 病位游移

正确答案：E。病位游移

解析：本题考查的是风邪的致病特点。风邪的致病特点是病位游移（E对）。六淫的性质及致病特点为：1.风邪的性质及致病特点。（1）风为阳邪，其性开泄，易袭阳位：风邪善动而不居，具有升发、向上、向外的特性，故属阳邪。其性开泄，是指其易使腠理疏松开张而汗出。常伤及人体的上部（即头面）、阳经和肌表，出现头痛、口眼㖞斜、恶风等症状。（2）风邪善行而数变：“善行”，是指风邪致病，具有病位游移，行无定处的特性。“数变”，是指风邪致病，具有变幻无常和发病迅速的特点。例如，风疹块（荨麻疹）就有皮肤成片风团瘙痒，发无定处，此起彼伏的特点。一般发病多急，传变也较快。（3）风为百病之长：风邪为六淫邪气的主要致病因素，凡寒、湿、燥、热诸邪，多依附于风邪而侵犯人体，如外感风寒、风热、风湿等。所以风邪常为外邪致病之先导，多兼他邪同病。2.寒邪的性质及致病特点。（1）寒为阴邪，易伤阳气：“阴盛则寒”，寒为阴气盛的表现，故其性属阴。又“阴盛则阳病”，感受寒邪，最易损伤人体阳气，阳气受损，温煦气化功能减弱，人体功能活动降低，从而表现为寒证。（2）寒性凝滞，主痛：“凝滞”即凝结、阻滞不通之意。寒邪伤人，阴气偏盛，阳气受损，经脉气血为寒邪凝滞不通，不通则痛。故寒邪伤人多见疼痛症状。例如，偏于寒盛之痹证，则多见疼痛较剧（A错）。（3）寒性收引：收引，有收缩牵引之意。寒邪侵袭人体，可使气机收敛，腠理、经络、筋脉收缩而挛急。例如，寒邪侵袭肌表，毛窍腠理闭塞，卫阳被郁不得宣泄，则可见恶寒发热、无汗等；寒客血脉，则气血凝滞，血脉挛缩，可见头身疼痛、脉紧；寒客经络关节，经脉拘急收引，则可使肢体屈伸不利，或冷厥不仁。3.暑邪的性质及致病特点。（1）暑为阳邪，其性炎热：暑为夏季火热之气所化，火热属阳，故暑为阳邪。暑邪伤人，多表现出阳热亢盛症状。（2）暑性升散，耗气伤津：暑为阳邪，有升发之特点，故暑邪侵犯人体，多直入气分，可使腠理开泄而多汗。暑热之邪，易于扰乱心神，则见心烦闷乱、神不安宁等。由于大量汗出，气随津泄而致气虚。所以，外伤暑邪，可见气短乏力，甚则突然昏倒、不省人事等。（3）暑多挟湿：夏季气候炎热，且雨水较多，热蒸湿动，空气中湿度增加，故暑邪致病，多挟湿邪，即暑邪湿邪合而致病。其临床表现是除发热、心烦、口渴外，还常兼见四肢困倦、胸闷恶心、大便溏泄或不爽等湿邪致病症状。4.湿邪的性质及致病特点。（1）湿为阴邪，易阻遏气机，损伤阳气：湿邪侵及人体，留滞于脏腑经络，最易阻遏气机，使气机升降失常，经络阻滞不畅，常可出现胸闷脘痞、小便短涩、大便不爽等症状。此外，湿为阴邪，易损伤阳气。脾主运化水湿，其性喜燥而恶湿，故外感湿邪，留滞体内，常先困脾气，使脾阳不振，运化水湿功能减弱，水湿停聚，出现腹泻、尿少、水肿、腹水等病证。（2）湿性重浊：“重”，即沉重或重着之意。感受湿邪，常可见头重如裹、周身困重（C错）、四肢酸懒沉重等症状。若湿邪留滞经络关节，则阳气输布受阻，故见肌肤不仁（B错）、关节疼痛重着等，又称“湿痹”或“着痹”。“浊”，即秽浊不清，多指分泌物和排泄物秽浊不清而言。临床症状多见面垢眵多、大便溏泻、下利黏液脓血、小便浑浊、妇女白带过多、湿疹浸淫流水等，都是湿邪秽浊的表现。（3）湿性黏滞：“黏”，即黏腻，“滞”，即停滞。湿邪黏腻停滞，主要表现在两个方面：一是指湿邪致病临床表现多黏滞不爽，如排出物及分泌物多滞涩而不畅；二是指湿邪为病多缠绵难愈，病程较长或反复发作。如湿温、湿痹、湿疹等病，皆因湿邪难以祛除而不易速愈。（4）湿性趋下，易伤阴位：湿邪伤人，其病多见于下部，如下肢水肿明显。此外，淋浊、带下、泄利等病证，亦多由湿邪下注所致。5.燥邪的性质及致病特点。（1）燥性干涩，易伤津液：燥邪最易耗伤人体的津液，造成阴津亏虚的病变，常见口鼻干燥、咽干口渴、皮肤干涩，甚则皲裂、毛发不荣、小便短少、大便干结等。（2）燥易伤肺：肺为娇脏，喜润而恶燥，所以既不耐寒温，更不耐干燥。肺主呼吸，与外界大气相通，外合皮毛，开窍于鼻，所以燥邪伤人，多从口鼻而入，故最易伤损肺津，影响肺的宣发与肃降功能，出现干咳少痰，或痰液胶黏难咳，或痰中带血，以及喘息胸痛等证。6.火邪的性质及致病特点。（1）火热为阳邪，其性炎上：阳主燥动而向上，火热之性，亦升腾上炎，故属阳邪。因此，火热伤人，多见高热、烦渴、汗出、脉洪数等症。又因其主动而炎上，故火热伤人则常见神明扰乱，表现为心烦、失眠、狂躁妄动、神昏谵语等。（2）火易伤津耗气：火热之邪最易迫津外泄，消灼津液，使人体津液耗伤。故火热邪气致病，除见高热之外，往往伴有口渴喜冷饮、口舌咽干、小便短赤、大便干结等津伤阴亏征象。此外，还认为火热亢盛，极易损伤正气，而使全身功能减弱。所以又有“壮火食气”之说。“壮火”，这里指火热邪气。（3）火热易生风动血：火热之邪侵袭人体，燔灼肝经，耗伤阴津，使筋失其滋养濡润而致运动失调，引起“肝风内动”，称为“热极生风”。临床表现为高热、神昏谵语、四肢抽搐、目睛上视、颈项强直、角弓反张等。此外，火热之邪可以加速血行，灼伤脉络，甚则迫血妄行（D错）而逸出脉外，而致各种出血。如吐血、衄血、便血、尿血、皮肤紫斑、妇女月经过多及崩漏等。（4）火热易发肿疡：火热之邪入于血分，则可聚于局部，腐蚀血肉，发为痈肿疮疡。其临床表现以疮疡局部红肿热痛为特征。